发热每于劳累后发生或加重，乏力，自汗，气短者，其证型是
A. 阴虚
B. 肝郁
C. 气虚
D. 血虚
E. 阳虚

正确答案：C。气虚

解析：本有气虚，劳则耗气，故见发热，热势或低或高，常在劳累后发作或加剧；脾胃虚弱，气血生化无源，脏腑经络失于充养，故见倦怠乏力，气短懒言；气虚表卫不固，故见自汗，易于感冒（C对）。阴虚发热证（A错）的表现为午后潮热，或夜间发热，不欲近衣，手足心热。肝郁发热证（B错）发热多为低热或潮热，热势随情绪波动而起伏，烦躁易怒。血虚发热证（D错）表现为低热，头晕眼花，体倦乏力，面色少华。阳虚发热证（E错）表现为发热而欲近衣，形寒怯冷，四肢不温，腰膝酸软。